义齿固位力与卡环臂进入基牙倒凹的深度和倒凹的坡度有关，一般
A. 倒凹的深度应大于1mm，倒凹的坡度应小于10°
B. 倒凹的深度应大于1mm，倒凹的坡度应小于20°
C. 倒凹的深度应小于1mm，倒凹的坡度应小于10°
D. 倒凹的深度应小于1mm，倒凹的坡度应小于20°
E. 倒凹的深度应小于1mm，倒凹的坡度应大于20°

正确答案：E。倒凹的深度应小于1mm，倒凹的坡度应大于20°

解析：本题考查可摘局部义齿基牙倒凹的深度和坡度。义齿固位力与卡环臂进入基牙倒凹的深度和倒凹的坡度有关，一般倒凹的深度应小于1mm，倒凹的坡度应大于20°（E对）。基牙的倒凹深度不超过1mm，坡度应大于20°；锥形牙、过小牙等牙冠固位形态差的牙一般不宜选作基牙。